为人体气血化生之源的脏是
A. 肾
B. 心
C. 肝
D. 肺
E. 脾

正确答案：E。脾

解析：脾主运化，运化食物和运化水液，两个方面。饮食物是人类出生后所需营养的主要来源，是生成精、气、血、津液的主要物质基础，而饮食物的消化及其精微的吸收、转输都有脾胃所主，是维持人体生命活动的根本故为后天之本。脾胃为气血生化之源，脾气不健，气血亏虚。（E对)(ABCD错）。